提示二尖瓣狭窄合并左心房增大的主要心电图改变是
A. 高尖P波
B. 双峰P波
C. 逆行P波
D. QRS波群宽
E. T波明显倒置

正确答案：B。双峰P波

解析：P波是心房肌去极化的电位变化，正常时限≤0.11秒。由于心房电除极时，左心房后除极，当左心房增大时，右心房除极完毕，而左心房由于增大，除极时间延长，表现在心电图上为P波增宽，其时限≥0.12秒，P波常呈双峰型，又称“二尖瓣型P波”（九版诊断学P494）。因此提示二尖瓣狭窄合并左心房增大的主要心电图改变是双峰P波（B对）。高尖P波（A错）又称“肺型P波”（九版诊断学P493），常见于右心房肥大。逆行P波（C错）常见于房室交界性早搏（P190）。QRS波群增宽（D错）常见于室性期前收缩。T波明显倒置（E错）常见于陈旧性心肌梗死（九版诊断学P503）。